以青霉素引起的最为常见的反应是
A. 皮肤过敏反应
B. 消化道过敏反应
C. 呼吸道过敏反应
D. 药物过敏性休克
E. 血清病

正确答案：D。药物过敏性休克

解析：药物过敏性休克：以青霉素引起的最为常见。青霉素的降解产物青霉噻唑醛酸或青霉烯酸与组织蛋白或细胞结合后可获得免疫原性，刺激机体产生IgE而使机体致敏。从空气中吸入青霉素降解产物或青霉菌孢子也可使人致敏。当致敏机体再次接触青霉素时即可发过敏反应，重者可发生过敏性休克甚至死亡。为防止青霉素过敏性休克，注射青霉素前必须做过敏试验。掌握“概述及Ⅰ型超敏反应”知识点。